反复使用某种抗生素，细菌可产生
A. 生理依赖性
B. 首剂现象
C. 耐药性
D. 耐受性
E. 致敏性

正确答案：C。耐药性

解析：本题考查耐药性。反复使用某种抗生素，细菌可产生耐药性（C对）。耐药性系指在化学治疗中，病原体或肿瘤细胞对化疗药物的敏感性降低的现象。生理依赖性（A错）又称躯体依赖性，是由于反复用药造成身体适应状态产生欣快感，一旦中断用药，可出现强烈的戒断综合征。如镇痛药吗啡、哌替啶，毒品海洛因等应用后，均可引起躯体依赖性和精神依赖性。首剂现象（B错）系指首剂药物引起强烈效应的现象。有些药物本身作用较强烈，首剂药物如按常量给予，可出现强烈的效应，致使患者不能耐受，如可乐定，首剂按常量应用，常出现血压骤降的现象。耐受性（D错）指在连续用药过程中，有的药物的药效会逐渐减弱，需加大剂量才能显效的现象。致敏性（E错）是某药品中含有使部分过敏人群发生过敏的物质。